落枕穴位于手背，第二、三掌骨间的
A. 指掌关节后0.5寸
B. 指掌关节后1寸
C. 指掌关节后1.5寸
D. 指掌关节后2寸
E. 指掌关节后2.5寸

正确答案：A。指掌关节后0.5寸

解析：落枕穴乃经外奇穴，定位在手背，第二、三掌骨间，指掌关节后约0.5寸，主治落枕、手臂痛、胃痛（A对，BCDE错）。